在消化性溃疡的发病机制中起关键作用是
A. 胃蛋白酶
B. 乙醇
C. 胃酸
D. 反流的胆汁
E. 不规则进食

正确答案：C。胃酸

解析：消化性溃疡是一种多因素疾病，溃疡的发病机制是胃酸对黏膜产生自我消化，故胃酸在溃疡形成中起关键作用。掌握“消化性溃疡”知识点。